以下哪种药物属于阿片类激动剂药物
A. 美沙酮
B. 纳诺酮
C. 曲纳酮
D. 利培酮
E. 丁螺环酮

正确答案：A。美沙酮

解析：美沙酮属于人工合成的阿片受体激动药（A对）。纳洛酮（B错）、曲纳酮（C错）是阿片受体的拮抗剂。利培酮（D错）为一种精神科药物，用于治疗急性和慢性精神分裂症。丁螺环酮（E错）是一种抗抑郁药，主要是作为5-羟色胺1A受体部分激动剂来达到抗焦虑作用。